单臀先露的两下肢姿势是
A. 髋关节屈曲，膝关节屈曲
B. 髋关节直伸，膝关节直伸
C. 髋关节直伸，膝关节屈曲
D. 髋关节屈曲，膝关节直伸
E. 以上都不是

正确答案：D。髋关节屈曲，膝关节直伸

解析：单臀先露胎儿双髋关节屈曲，双膝关节直伸（D对）以臀部先露，称为单臀先露，又称腿直臀先露，此类最多见。髋关节屈曲，膝关节屈曲（A错）是完全臀先露的两下肢姿势。